女性，28岁，牙龈刷牙出血2年。检查：全口牙石（+），牙龈缘轻度红肿，探诊出血，探诊深度2mm，未见牙龈退缩。此时对该患者的治疗方法应为
A. 洁治术
B. 刮治术
C. 根面平整
D. 口服替硝唑
E. 袋壁搔刮

正确答案：A。洁治术

解析：本题考查慢性龈炎。去除病因：通过洁治术（A对）彻底清除菌斑、牙石，消除造成菌斑滞留和局部刺激牙龈的因素。对于牙龈炎症较重的患者，可配合局部药物治疗，常用的局部药物有1%过氧化氢、0.12%～0.2%氯己定溶液以及碘制剂。对于不伴有全身疾病的慢性龈炎患者，不应全身使用抗菌药物。